治疗烧烫伤，应选用
A. 大黄
B. 芦荟
C. 番泻叶
D. 甘遂
E. 大戟

正确答案：A。大黄

解析：该题考查大黄的功效应用，属记忆内容。大黄味苦，性寒，入脾、胃、大肠、肝、心包经，其功效为泻下攻积，清热泻火，凉血解毒，逐瘀通经，具有治疗烧烫伤的功能（A对BCDE错）。